临床主要用于鼠疫杆菌和结核杆菌感染的抗生素为
A. 庆大霉素
B. 妥布霉素
C. 阿米卡星
D. 卡那霉素
E. 链霉素

正确答案：E。链霉素